女，26岁。患重症肌无力5年，因感冒后肌无力加重，大量服用溴化吡啶斯的明后出现流口水、大量出汗、肌束颤动、腹痛。此种表现是由于
A. Ach毒蕈碱样作用亢进
B. 中枢Ach神经元传递减慢
C. 神经肌肉接头处Ach兴奋传递加速
D. 乙酰胆碱（Ah）神经元的后发放
E. Ach烟碱样作用亢进

正确答案：D。乙酰胆碱（Ah）神经元的后发放

解析：患者女，26岁，既往有重症肌无力的病史，出现感冒后肌无力加重的表现，在服用溴化吡啶斯的明后出现流口水、大量出汗、肌束颤动、腹痛的表现，出现此种表现是由于乙酰胆碱（Ach）神经元的后发放。 原因包括（1）腺体：ACh可使泪腺、气管和支气管腺体、唾液腺、消化道腺体和汗腺分泌增加； （2）ACh会刺激支气管收缩，产生腹痛 （3）神经节和骨骼肌：ACh作用于自主神经节NN胆碱受体和骨骼肌神经肌肉接头的NM胆碱受体，引起交感、副交感神经节兴奋及骨骼肌收缩。进而肌束颤动。 因此，题中患者的表现都符合乙酰胆碱（Ach）神经元的后发放（D对）。